女，42岁。发热2个月，体温38℃左右，发现左腹股沟可触及5cm×5cm质软肿物，按压痛。B超显示其为低回声。腰椎正位片示腰大肌阴影增宽，L1、L2椎体边缘骨质破坏，椎间隙狭窄。首先应考虑的诊断是
A. 骨髓炎
B. 腰椎结核
C. 骨巨细胞瘤
D. 转移性骨肿瘤
E. 类风湿关节炎

正确答案：B。腰椎结核

解析：中年女性，低热2个月（提示患者可能患有结核），腰椎（L1、L2）椎体边缘骨质破坏，椎间隙狭窄（椎间隙狭窄常见于成人边缘型椎体结核，腰椎为好发部位），腰椎正位片示腰大肌阴影增宽（提示椎体破坏后有寒性脓肿的形成，腰大肌阴影增宽系下胸椎及腰椎病变所致的椎旁脓肿穿破骨膜后，聚集在腰大肌鞘内所致），可以诊断为腰椎结核（B对）。骨髓炎（A错）常由化脓性细菌感染引起，常发生在长骨干骺端，以胫骨上端多见，不累及腰椎，不出现椎间隙狭窄等表现（P738）。骨巨细胞瘤（C错）好发于20～40岁，女性略多，好发部位为长骨干骺端和椎体，典型的X线特征为骨端偏心位、溶骨性、囊性破坏而无骨膜破坏，呈肥皂泡样改变（P776）。转移性骨肿瘤（D错）常见于中老年病人，好发部位为躯干骨，主要症状是疼痛、肿胀、病理性骨折和脊髓压迫，X线可表现为骨质破坏，但椎间隙一般正常（P779）。类风湿关节炎（E错）多发生在20-45岁，女性多见，好发于手、腕、足等小关节，反复发作，呈对称分布。颈椎可受累，腰椎极少受累（P766）。